男孩，5岁。持续高热1周。查体:T39℃，P128次/分，R36次/分。热病容，双眼结合膜充血，口唇干裂，可见草莓舌。皮肤呈弥漫性红斑，颈部浅表淋巴结肿大。心音有力，手足指趾硬性水肿。最可能的诊断是
A. 川崎病
B. 手足口病
C. 败血症
D. 风湿热
E. 猩红热

正确答案：A。川崎病

解析：发热5天以上，伴有下列其中4项者，排除其他疾病即可诊断为川崎病：①四肢变化：掌跖红斑，手足硬性水肿；恢复期蜕皮；②多形性红斑；③眼结合膜充血，非化脓性；④唇充血皲裂，口腔黏膜充血，草莓舌；⑤颈部淋巴结肿大。该患者的症状、体征均符合上述5项标准，故诊断为川崎病（A对）。手足口病患儿口腔可见疱疹或溃疡，手、足、臀部可见斑丘疹或疱疹（B错）。败血症患儿有原发灶感染，感染中毒症状明显，可有出血点、斑疹、丘疹等（C错）。风湿热患儿有链球菌咽峡炎病史，表现为关节炎、心脏炎、皮下结节、环形红斑、舞蹈病（D错）。猩红热也有草莓舌，但是没有手足硬性水肿仅仅是苍白圈、帕氏线（E错）。